早产儿的胎龄应是
A. ＞25周至＜37足周
B. ＞26周至＜37足周
C. ＞27周至＜38足周
D. ＞28周至＜37足周
E. ＞28周至＜38足周

正确答案：D。＞28周至＜37足周

解析：胎龄（GA）是指从最后1次正常月经第1天起至分娩时止，通常以周表示，分为足月儿、早产儿和过期儿。早产儿是28周≤胎龄＜37周的新生儿（D对）。胎龄“＞25周至＜37足周”（A错）、“＞26周至＜37足周”（B错）和“＞27周至＜38足周”（C错）不是早产儿的胎龄，是因为胎龄＜28周为极早早产儿或未成熟儿。胎龄＞28周至＜38足周不是早产儿，是因为胎龄37周≤胎龄＜42周的新生儿为足月儿（E错）。